女，60岁。5天前无明显诱因出现右腹胀痛，伴畏寒、寒战、发热，最高体温39.2℃，食欲不振，乏力。查体：T38.5℃，P90次／分，R20次／分，BP140/80mmHg，双肺未闻及干湿性啰音，心律齐，腹软，无肌紧张，肝肋下5cm，有压痛。血常规：Hb120g/L，WBC12.2×10⁹/L，N0.92，Plt122×10⁹/L。腹部B超：右肝内多个直径2cm～3cm液性暗区。抗感染主要针对得细菌是
A. 大肠埃希菌
B. 表皮葡萄球菌
C. 鲍曼不动杆菌
D. 铜绿假单胞菌
E. 梭状芽胞杆菌

正确答案：A。大肠埃希菌

解析：患者老年女性（免疫力低下，易感染机会性致病菌），5天前无明显诱因（提示由自身菌群导致的机会性感染可能性较大）出现右腹胀痛，伴畏寒、寒战、发热，最高体温39.2℃，食欲不振，乏力（化脓性感染典型临床表现）。查体：肝肋下5cm，有压痛。血常规：Hb120g/L，WBC12.2×10⁹/L（正常值4～10×10⁹/L），N0.92（正常值0.40～0.75），以上提示有炎症，PLT122×10⁹/L。腹部B超：右肝内多个直径2cm～3cm液性暗区（提示为脓肿）。据患者年龄、临床表现、体征及影像学检查，初步推断患者为因免疫力低下导致的大肠埃希菌感染性肝脓肿（A对），可通过病原学检查进一步明确病因。表皮葡萄球菌（P91）（B错）是人体正常菌群，可引起女性急性膀胱炎，人工瓣膜感染等疾病。鲍曼不动杆菌（P172）（C错）是机会性致病菌，是导致医院感染的常见病菌之一。铜绿假单胞菌（P169）（D错）是常见的机会性致病菌之一，在医院感染中亦常见，其感染多见于皮肤黏膜受损部位，如烧伤、创伤或手术切口等，也因长期化疗或使用免疫抑制剂的患者，表现为局部化脓性炎症等。梭状芽胞杆菌（E错）自然中常见，当其因进入到人体内时，多导致肌肉和软组织、肠道等神经中毒性疾病。临床上有致病性的主要是某些厌氧芽胞杆菌，如破伤风梭菌、产气荚膜梭菌、肉毒梭菌等，分别引起破伤风、气性坏疽、食物中毒等疾病。